伤寒患者病变出现的位置是
A. 回肠末端
B. 升结肠
C. 乙状结肠
D. 肝、脾
E. 心、脑

正确答案：A。回肠末端

解析：伤寒患者病变出现的位置是回肠末端（A对）淋巴组织。升结肠（B错）和盲肠是肠阿米巴病（P369）的好发部位。乙状结肠（C错）和直肠是细菌性痢疾（P359）的好发部位。